小金胶囊能消瘀消肿，化瘀止痛，善治痰气凝滞所致病证，主要有
A. 瘰疬
B. 乳癖
C. 瘿瘤
D. 乳岩
E. 乳痛红肿

正确答案：A、B、C、D。瘰疬；乳癖；瘿瘤；乳岩

解析：本题考查的是小金胶囊的主治。小金胶囊能消瘀消肿，化瘀止痛，善治痰气凝滞所致病证，主要有瘰疬（A对）、乳癖（B对）、瘿瘤（C对）与乳岩（D对）。小金丸：【主治】痰气凝滞所致的瘰疬、瘿瘤、乳岩、乳癖，症见肌肤或肌肤下肿块一处或数处、推之能动，或骨及骨关节肿大、皮色不变、肿硬作痛。